哪种疾病外周血中性粒细胞碱性磷酸酶积分常呈阴性结果
A. 骨髓纤维化
B. 细菌性肺炎
C. 慢性髓系白血病
D. 急性淋巴细胞白血病
E. 类白血病反应

正确答案：C。慢性髓系白血病

解析：慢性髓系白血病的中性粒细胞碱性磷酸酶 (NAP)活性减低或呈阴性反应（C对）。